流行病学研究主要解决的问题是
A. 疾病分布及影响分布的因素
B. 疾病的防治措施
C. 疾病病因
D. 增进人群健康的策略
E. 以上都对

正确答案：E。以上都对